前致癌物
A. 活化过程中接近终致癌物的代谢产物
B. 不经代谢活化就有致癌活性的物质
C. 经代谢活化仍无致癌活性的物质
D. 经代谢活化才有致癌活性的物质
E. 经代谢转化最后产生的有致癌活性的代谢产物

正确答案：D。经代谢活化才有致癌活性的物质

解析：本题考查前致癌物。前致癌物指经代谢活化才有致癌活性的物质（D对ABCE错）。